下列指数中用于判断口腔卫生状况的是
A. 牙龈指数
B. 菌斑指数
C. 龈沟出血指数
D. 探诊出血
E. 牙周指数

正确答案：B。菌斑指数

解析：本题考查用于判断口腔卫生状况的指数。用于判断口腔卫生状况的是菌斑指数（B对）。菌斑指数用于评价口腔卫生状况和衡量牙周病防治效果。牙龈指数只观察牙龈情况，检查牙龈颜色和质地的改变及出血倾向，病变程度的分级，可分为4级；0=正常牙龈；1=牙龈略有浮肿，探针谈之不出血；3=牙龈有自发出血倾向或溃疡（A错）。龈沟出血指数牙龈出血早于外形颜色和改变出现，在临床应用不多（C错）。探诊出血（BOP）根据探诊有无出血，记为BOP阳性或阴性，被视为牙龈有无炎症的较客观指标（D错）。社区牙周指数反映牙周组织的健康状况，也反应牙周治疗需要情况，操作简单，被世界卫生组织采纳，推荐作为牙周病流行病学调查指数（E错）。